女性生殖器结核的病理变化，正确的是
A. 输卵管结核多为双侧性，由子宫内膜结核蔓延而来
B. 卵巢结核通常是卵巢深部形成结节和干酪样坏死
C. 子宫内膜结核可使子宫腔黏连、变形、缩小
D. 宫颈结核在生殖道结核中最常见
E. 盆腔腹膜结核分黏连型和渗出型，黏连型不易形成瘘管

正确答案：C。子宫内膜结核可使子宫腔黏连、变形、缩小

解析：输卵管结核占女性生殖器结合的90%～100%，即几乎所有的生殖器结核均累及输卵管，双侧性居多，其主要通过血行感染，依次扩散到子宫内膜、卵巢，侵犯宫颈、阴道、外阴者较少（A错）。子宫内膜结核时，子宫内膜受到不同程度结核病变破坏，最后代以瘢痕组织，可使子宫腔黏连变形缩小（C对）。卵巢结核时，因有白膜包围，通常仅有卵巢周围炎，侵犯卵巢深层较少，卵巢深部很少见结节和干酪样坏死（B错）。宫颈结核在生殖道结核中较少见（D错），占生殖器结核的10%～20%。盆腔腹膜结核分粘连型和渗出型，粘连型特点为腹膜增厚，与邻近脏器之间发生紧密粘连，粘连的组织常发生干酪样坏死，易形成瘘管（E错）。